带教老师教育学生要认识自己长处和短处，其意义是
A. 全面的观点认识自我
B. 分清主流和支流的观点看待自己
C. 发展的眼光看待自己
D. 分清光明与阴暗面的观点看待自己
E. 以上均正确

正确答案：A。全面的观点认识自我

解析：正确认识自己，既要看到自己的长处又要看到自己的短处，要做到用全面的、发展的眼光看待自我（A对）。